能清肝明目的药是
A. 知母
B. 芦根
C. 竹叶
D. 青葙子
E. 天花粉

正确答案：D。青葙子

解析：本题考查的是青葙子的功效。能清肝明目的药是青葙子（D对）。青葙子：【功效】清肝泻火，明目退翳。知母（A错）：【功效】清热泻火，滋阴润燥。芦根（B错）：【功效】清热生津，除烦止呕，利尿。竹叶（C错）：【功效】清热除烦，生津，利尿。天花粉（E错）：【功效】清热生津，清肺润燥，消肿排脓。